下列牙齿变色属于内源性着色的是
A. 吸烟导致的烟斑
B. 喝茶导致的牙齿染色
C. 龋齿因为硝酸银处理而变黑
D. 四环素导致的四环素牙
E. 长时间未刷牙引起的“黄牙板”

正确答案：D。四环素导致的四环素牙

解析：牙齿着色分为外源性和内源性，其中外源性着色包括细菌着色、铁、烟草、食物和饮料、牙龈出血、修复性材料、药物等。而四环素牙是由于四环素与牙齿硬组织结合导致的内源性着色。掌握“四环素牙”知识点。